女，68岁。1年前于坐位早餐时无明显诱因突感心悸，随之意识丧失跌倒，数分钟后意识恢复。无大汗、肢体抽搐、口吐白沫和大小便失禁。1年来反复发作上述症状3次，发作与体位和运动无关。查体：BP130/70mmHg，心率48次/分。心电图示二度Ⅱ型房室传导阻滞。该患者意识丧失最可能的原因是
A. 低血糖
B. 心律失常
C. 癫痫发作
D. 体位性低血压
E. 迷走神经张力增高

正确答案：B。心律失常

解析：患者老年女性，突感心悸，意识丧失跌倒（脑供血不足表现）。心率48次/分（正常值60～100次/分），心电图示二度Ⅱ型房室传导阻滞，考虑为二度房室阻滞突然进展为完全性房室阻滞，而引起Adams-Strokes综合征（阿-斯综合征）。阿-斯综合征即心源性脑缺血综合征，是指突然发作的严重的、致命性缓慢性或快速性心律失常，使心排血量在短时间内锐减，导致严重脑缺血，患者可出现暂时性意识丧失，甚至抽搐。该患者意识丧失最可能的原因是心律失常导致的严重脑供血不足（B对）。低血糖（P750-P751）（A错）指静脉血浆葡萄糖浓度低于2.8mmol/L，多表现为出汗、饥饿、颤抖、软弱无力、面色苍白、心率加快、头晕、嗜睡等，而突发意识丧失少见。癫痫发作（C错）是指由脑部神经元的过度放电引起的一种急性、反复发作、阵发性的大脑功能紊乱，表现为意识、运动、植物神经和精神障碍。儿童和青少年发病率最高，且多伴有肢体抽搐口吐白沫和大小便失禁。体位性低血压（D错）指从平卧位突然转为直立，或长时间站立发生的脑供血不足引起的低血压。迷走神经张力增高（E错）常表现为为心率过缓，多于睡眠、屏气时发生，很少数分钟内缓解。